肩周炎不正确的治疗方法是
A. 理疗
B. 封闭
C. 按摩
D. 服用非甾体抗炎药物
E. 限制肩关节活动

正确答案：E。限制肩关节活动

解析：肩周炎的治疗目的是缓解疼痛，恢复功能，避免肌肉萎缩。理疗（A对）、局部封闭治疗（B对）、按摩（C对）、短期服用非甾体抗炎药物（D对）、主动地肩关节活动（E错，为本题正确答案）等均可缓解症状。症状重者可采用手法或关节镜下松解粘连治疗。对于肩外因素所致的肩周炎还需对原发病进行治疗。